最常见的女性不孕因素是
A. 宫体因素
B. 精神因素
C. 阴道因素
D. 输卵管因素
E. 宫颈因素

正确答案：D。输卵管因素

解析：最常见的女性不孕因素是输卵管因素（D对）。女性不孕因素包括盆腔因素和排卵障碍，以盆腔因素为主。盆腔因素中又以输卵管因素最常见。宫体因素（A错）、精神因素（B错）、阴道因素（C错）、宫颈因素（E错）均可导致不孕，但不是最常见的女性不孕因素。